分子中含有咪唑环和氰胍基，第一个应用于临床的H₂受体阻断药是
A. 罗沙替丁
B. 尼扎替丁
C. 法莫替丁
D. 西咪替丁
E. 雷尼替丁

正确答案：D。西咪替丁

解析：本题考查西咪替丁。分子中含有咪唑环和氰胍基，第一个应用于临床的H₂受体阻断药是西咪替丁（D对）。西咪替丁是抗溃疡药，属于组胺H₂受体阻断剂，化学结构由咪唑五元环、含硫醚的四原子链和末端取代胍三个部分构成。雷尼替丁（E错）分子中的碱性基团为二甲胺甲基呋喃，药效团为二氨基硝基乙烯。法莫替丁（C错）、尼扎替丁（B错）药物分子中含有噻唑环。罗沙替丁（A错）是用哌啶甲苯环代替了在雷尼替丁、法莫替丁、尼扎替丁和西咪替丁结构中的五元碱性芳杂环。